下列哪项属于伤害的一级预防措施
A. 安全带
B. 救生衣
C. 防弹衣
D. 心肺复苏
E. 游泳池周围的栅栏

正确答案：E。游泳池周围的栅栏